男，8岁。右足底被铁锈钉刺伤12天，出现张口困难，继之出现苦笑面容，角弓反张，声响及触碰病人可诱发上述症状，神志清楚，无发热。该病致病菌属于
A. 革兰阴性大肠杆菌
B. 革兰阴性厌氧拟杆菌
C. 革兰阴性变形杆菌
D. 革兰阳性厌氧芽孢杆茵
E. 革兰阳性梭形芽孢杆菌

正确答案：D。革兰阳性厌氧芽孢杆茵

解析：患者右足底被铁锈钉刺伤（深部创伤），后出现张口困难，苦笑面容，角弓反张，声响及触碰病人可诱发上述症状，应诊断为破伤风（破伤风是是常和创伤相关联的一种特异型感染。其典型表现为张口困难、哭笑面容、角弓反张等肌肉痉挛症状，可因轻微的刺激，如光、声、接触、饮水等诱发）。破伤风由破伤风梭菌引起，其为革兰染色阳性厌氧芽孢杆菌（D对）。革兰染色阴性大肠杆菌（A错）常为肠源性感染的致病菌。革兰染色阴性厌氧拟杆菌（B错）常为继发性腹膜炎的致病菌。革兰染色阴性变形杆菌（C错）常为食物中毒的常见致病菌。革兰染色阳性梭形芽孢杆菌（E错）为气性坏疽的致病菌。